下面哪种因果联接方式，在探讨病因时，能够全面反映事物的本来面目
A. 单因单果
B. 单因多果
C. 多因单果
D. 多因多果

正确答案：D。多因多果

解析：本题考查因果关系的多样性。多因多果（D对ABC错）在探讨病因时，能够全面反映事物的本来面目。多因多果的病因现象增加了病因研究的复杂性和不确定性，同时也揭示了多种途径预防疾病的可能性。